金花消痤丸除解毒消肿外又能
A. 清热定痛
B. 清热泻火
C. 清热除湿
D. 清热凉血

正确答案：B。清热泻火

解析：本题考查金花消痤丸的功能。金花消痤丸除解毒消肿外又能清热泻火（B对）。金花消痤丸【功能】清热泻火，解毒消肿。痛风定胶囊【功能】清热祛湿，活血通络定痛（A错）。消风止痒颗粒【功能】清热除湿（C错），消风止痒（E错）。消银颗粒（片）【功能】清热凉血（D错），养血润肤，祛风止痒。